某女，5岁。1个月来，咳嗽阵作，痰鸣气促，咽干声哑。证属痰浊阻肺之顿咳。治当宣肺、化痰、止咳，宜选用的成药是
A. 一捻金
B. 鹭鸶咯丸
C. 解肌宁嗽丸
D. 儿童清肺丸
E. 清宣止咳颗粒

正确答案：B。鹭鸶咯丸

解析：本题考查的是鹭鸶咯丸的功能。1个月来，咳嗽阵作，痰鸣气促，咽干声哑。证属痰浊阻肺之顿咳。治当宣肺、化痰、止咳，宜选用的成药是鹭鸶咯丸（B对）。鹭鸶咯丸：【功能】宣肺，化痰，止咳。一捻金（A错）：【功能】消食导滞，祛痰通便。解肌宁嗽丸（C错）：【功能】解表宣肺，止咳化痰。儿童清肺丸（D错）：【功能】清肺，解表，化痰，止嗽。清宣止咳颗粒（E错）：【功能】疏风清热，宣肺止咳。